下列不属于患者在辅助检查过程中医技人员遵循的道德要求是
A. 综合分析检查结果，切忌片面性
B. 严谨求实，防止差错
C. 工作敏捷，尊重患者
D. 精心管理，保证安全
E. 积极进取，加强协作

正确答案：A。综合分析检查结果，切忌片面性